以下哪一种属于从治法
A. 热者寒之
B. 寒者热之
C. 以补开塞
D. 以补治虚
E. 以上都不是

正确答案：C。以补开塞

解析：正治，指采用与证候性质相反的方药进行治疗的治则。由千采用方药或措施的性质与证候的性质相逆，如寒者热之、热者寒之、虚则补之、实则泻之（ABD错）。从治适用于疾病的征象与其本质不完全符合的病证，主要包括四个方面：热因热用即以热治热，是指用温热方药或具有温热功效的措施来治疗具有假热征象的治法。寒因寒用即以寒治寒，是指用寒凉方药或具有寒凉功效的措施来治疗具有假寒征象的治法。塞因塞用即以补开塞，是指用补益、固涩方药或具有补益、固涩功效的措施来治疗具有闭塞不通症状的治法（C对）。通因通用即以通治通，是指用通利方药或具有通利功效的措施来治疗具有通泻症状的治法。